槐米中治疗出血症的有效成分是
A. 槐二醇
B. 芦丁
C. 金丝桃苷
D. 杜鹃素
E. 槲皮素

正确答案：B。芦丁

解析：本题考查的是槐米中的有效成分及其作用。槐米中治疗出血症的有效成分是芦丁（B对）。槐花中主要成分及其化学结构：槐米含有芦丁，槲皮素（E错），皂苷，白桦脂醇，槐二醇（A错）以及槐米甲、乙、丙素和黏液质等。其中，芦丁是有效成分，可用于治疗毛细血管脆性引起的出血症，并用做高血压的辅助治疗剂。槐米中芦丁的含量高达23.5%，槐花开放后降至13.0%。《中国药典》以总黄酮和芦丁为指标成分对槐米或槐花进行含量测定。要求槐花总黄酮（以芦丁计）不少于8.0%，槐米总黄酮不少于20.0%，对照品采用芦丁；要求芦丁含量，槐花不得少于6.0%，槐米不得少于15.0%。金丝桃苷（C错）与杜鹃素（D错）为满山红的化学成分。满山红叶中含有杜鹃素、8-去甲基杜鹃素、山柰酚、槲皮素、杨梅素、金丝桃苷、异金丝桃苷以及莨菪亭、伞形酮、木毒素、牻牛儿酮、薄荷醇、杜松脑和α-桉叶醇、β-桉叶醇、γ-桉叶醇等。其中杜鹃素为祛痰成分，临床用于治疗慢性支气管炎。《中国药典》以杜鹃素为对照品对满山红进行含量测定。要求杜鹃素含量不少于0.08%。